对侧半身感觉障碍并伴有偏瘫，属于感觉障碍的类型是
A. 神经根型
B. 脑干型
C. 脊髓横贯型
D. 内囊型
E. 末梢型

正确答案：D。内囊型

解析：对侧半身感觉障碍并伴有偏瘫，属于感觉障碍的类型是内囊型（D对）。神经根型颈部颈椎棘突或棘突间的直接压痛或叩痛多为阳性，根性痛，根性肌力障碍，以前根先受压者为明显，早期肌张力增高，但很快即减弱并出现肌萎缩（A错）。脑干型感觉障碍属传导束型感觉障碍，发生的症状依据受损部位而异（B错）。脊髓横贯型脊髓症状出现急骤，病人初始多为局部颈背痛或腹痛，胸腹束带感等神经根刺激症状，然后突然出现双下肢麻木，无力，感觉缺失及二便障碍。多数患者于数小时或1-2天内达到最高峰，发展为脊髓完全的横贯性损害（C错）。末梢型感觉障碍表现为四肢对称性的末端各种感觉障碍（温、痛、触觉和深感觉），呈手套-袜套样分布（E错）。